男，62岁。腹部阵发性疼痛伴腹胀，停止排气排便2天。既往有类似发作，但较轻。查体：P100次/分，BP110/70mmHg，腹肌紧张，压痛明显，反跳痛阳性，移动性浊音阳性，最可能的诊断是
A. 麻痹性肠梗阻
B. 不全性粘连性肠梗阻
C. 绞窄性肠梗阻
D. 完全性高位肠梗阻
E. 单纯性机械性肠梗阻

正确答案：C。绞窄性肠梗阻

解析：老年男性患者，进行性腹痛伴腹胀，停止排气排便2天（提示肠梗阻），腹肌紧张，压痛明显，反跳痛阳性（腹膜刺激征），移动性浊音阳性（提示肠梗阻发生绞窄），结合患者病史和体查，应诊断为绞窄性肠梗阻（C对）。麻痹性肠梗阻（A错）以腹胀为突出表现，由于肠壁肌呈瘫痪状态，没有收缩蠕动，因此一般不出现腹痛。不全性粘连性肠梗阻（B错）的患者多有腹腔内手术、创伤、炎症、出血等病史。完全性高位肠梗阻（D错）常表现为剧烈呕吐，呕吐较频繁，腹胀不明显。单纯性机械性肠梗阻（E错）常表现为阵发性腹痛，由于肠管无血运障碍，因此一般不会出现腹膜刺激征及腹部移动性浊音。